冷冻食品的粪便污染指示菌，目前趋向选用
A. 大肠菌群
B. 肠杆菌属
C. 肠球菌属
D. 克雷伯菌属
E. 志贺菌属

正确答案：C。肠球菌属